小缺失
A. 染色体的非染色带无线状连接
B. 染色体的非染色带有线状连接
C. 光镜下不可见的DNA缺失
D. 远离原位的染色体断裂节段
E. 有染色质缺失的染色体

正确答案：C。光镜下不可见的DNA缺失

解析：本题考查小缺失。小缺失指基因突变片段损伤中远远小于光学显微镜下可观察到的染色体缺失的DNA缺失的片段（C对ABDE错）。